不利于大气煤烟型污染物扩散的气象条件是
A. 气温高，气湿低，风速大，无逆温
B. 气温低，气湿高，风速小，有逆温
C. 有湍流，大气稳定度小
D. 紫外线强烈，出现反气旋
E. 夏秋季节，午后至日落以前

正确答案：B。气温低，气湿高，风速小，有逆温

解析：本题考查不利于大气煤烟型污染物扩散的气象条件。大气煤烟型污染物的扩散受气象条件的影响很大，高温低湿，大风速和无逆温的条件有利于污染物的扩散；而低温高湿，小风速和有逆温（B对ACDE错）的条件则不利于污染物的扩散。